在成人，脊蛛网膜下隙正常从枕骨大孔延伸至下列哪一椎体的下缘
A. L1
B. L2
C. L4
D. L5
E. S2

正确答案：E。S2

解析：在成人，脊蛛网膜下隙正常从枕骨大孔延伸至S2（E对）的下缘。而将脊髓下端至第2骶椎之间扩大的蛛网膜下隙，称终池。